女，25岁。停经19周。剧烈腹痛、发热1天，无阴道流血。血常规，WBC14×10⁹/L，N0.76，B超提示单胎妊娠合并子宫肌壁间肌瘤，直径10cm，可能的诊断是子宫肌瘤合并
A. 玻璃样变
B. 肉瘤变
C. 感染
D. 囊性变
E. 红色样变

正确答案：E。红色样变

解析：患者妊娠期合并子宫肌瘤，剧烈腹痛、发热，无阴道流血，白细胞计数升高，可能的诊断是红色样变（E对）。玻璃样变（A错）肌瘤剖面漩涡状结构消失，由均匀透明样物质取代。肉瘤变（B错）多见于绝经后子宫肌瘤伴疼痛和出血的患者。囊性变（D错）为子宫肌瘤玻璃样变继续发展，肌细胞坏死液化形成，此时子宫肌瘤变软。妊娠期感染（C错），患者常见阴道流血。